下列关于糖尿病影响因素的说法，不正确的是
A. 1型糖尿病的遗传倾向比2型糖尿病更明显
B. 1型糖尿病占我国糖尿病患者的85%以上
C. 肥胖是糖尿病的重要影响因素之一。
D. 重度肥胖儿童10岁左右即可发展成2型糖尿病
E. 高血压是2型糖尿病的一个独立的危险因素

正确答案：B。1型糖尿病占我国糖尿病患者的85%以上